男，66岁。5年前诊断左股骨颈骨折。近1年左髋疼痛，行走困难。X线片示左髋关节间隙变窄，股骨头变形。最佳治疗方案是
A. 左下肢皮肤牵引
B. 切开复位钢板内固定
C. 人工关节置换术
D. 闭合复位内固定
E. 卧床休息对症治疗

正确答案：C。人工关节置换术

解析：老年男性患者，左股骨颈骨折史（陈旧性骨折史），近1年左髋疼痛、行走困难，X线片示左髋关节间隙变窄，股骨头变形（提示可能为骨关节炎（P761），骨关节炎可由关节内骨折继发形成，X线检查示关节间隙狭窄，关节边缘增生和骨赘形成），结合患者病史、临床表现和影像学检查，应考虑陈旧性股骨颈骨折合并骨关节炎，故该患者最佳治疗方案为人工关节置换术（C对）。皮肤牵引（八版外科学P678）（A错）、卧床休息对症治疗（E错）为股骨颈骨折的非手术治疗，适用于无明显位移、外展型或嵌入型等稳定性骨折及年龄过大、全身情况差、无法耐受手术者。闭合复位内固定（D错）常用于儿童股骨颈骨折的治疗。切开复位内固定（B错）主要用于内收型、有明显移位的股骨颈骨折。